乳牙酸蚀的时间最好为
A. 20秒
B. 30秒
C. 40秒
D. 50秒
E. 60秒

正确答案：E。60秒

解析：恒牙酸蚀的时间一般为20～30秒，乳牙酸蚀60秒。注意酸蚀过程中不要擦拭酸蚀牙面，因为这会破坏被酸蚀的牙釉面，降低黏结力。放置酸蚀剂时要注意酸的用量适当，不要溢出到口腔软组织，还要注意避免产生气泡。掌握“窝沟封闭术”知识点。